对急性重型肝炎抢救效果进行评价时，恰当的指标应是
A. 死亡率
B. 发病率
C. 患病率
D. 病死率
E. 罹患率

正确答案：D。病死率

解析：本题考查病死率的应用。病死率（D对ABCE错）表示确诊某病者的死亡概率，它可反映疾病的严重程度，也可反映医疗水平和诊治能力，常用于急性传染病，也可用于慢性病。